慢性阻塞性肺疾病患者肺功能检查最可能出现的异常结果
A. CO弥散量（DLCO）下降
B. 残气量（RV）下降
C. 支气管舒张试验阳性
D. 第一秒用力呼气容积（FEV₁）下降
E. 肺总量（TLC）下降

正确答案：D。第一秒用力呼气容积（FEV₁）下降

解析：慢性阻塞性肺疾病简称慢阻肺，其特征是持续存在的呼吸系统症状和气流受限，肺功能检查第一秒用力呼气容积（FEV₁）下降（D对），残气量（RV）增高（B错），肺总量（TLC）增高（E错）。慢阻肺特征性的病理生理变化是持续气流受限致肺通气功能障碍，其气流受限不可逆，故支气管舒张试验阴性（C错）。慢阻肺前期不影响肺换气功能，因此CO弥散量（DLCO）不变（A错）。